L30D-55的作用是
A. 缓释包衣材料
B. 胃溶包衣材料
C. 肠溶包衣材料
D. 肠溶载体
E. 黏合剂

正确答案：A。缓释包衣材料

解析：本题考查氧氟沙星缓释胶囊。该制剂处方中EudragitNE30D、EudragitL30D-55的作用是缓释包衣材料（A对）。氧氟沙星缓释胶囊中氧氟沙星为主药；丸芯中枸橼酸为pH缓冲剂和渗透压调节剂；微晶纤维素和乳糖为稀释剂；包衣液处方中PEG6000为增塑剂；滑石粉为抗黏剂；Eudragit NE30D和Eudragit L30D-55为主要缓释包衣材料；水为溶剂，十二烷基硫酸钠为稳定剂。